男，74岁。腹股沟疝修补术后2年，复发3个月，要求再手术治疗。考虑患者年老、腹壁薄弱，最适宜的术式是
A. Bassini法
B. McVay法
C. Halsted法
D. Ferguson法
E. Lichtenstein法

正确答案：E。Lichtenstein法

解析：老年男性患者，腹股沟疝修补术后复发。由于该患者年龄较大，腹壁薄弱，再次手术时应选择的最佳术式是Lichtenstein法（平片无张力疝修补术）（E对）。Lichtenstein法（P313）是使用一适当大小的补片材料置于腹股沟管后壁，多用于复发疝和复杂疝。Bassini法（A错）、McVay法（B错）、Halsted法（C错）和Ferguson法（D错）均为传统的疝修补术，对腹壁薄弱的复发疝患者效果不佳。